代谢性碱中毒常伴发
A. 低钾血症
B. 低钙血症
C. 低钠血症
D. 低磷血症
E. 低镁血症

正确答案：A。低钾血症

解析：低钾血症时，K⁺从细胞内移至细胞外，每3个K⁺从细胞内释放，就有2个Na⁺和1个H⁺进入细胞内，引起代谢性碱中毒；同理，代谢性碱中毒时，H⁺进入细胞内减少，K⁺从细胞内移至细胞外减少，从而导致低钾血症。因此代谢性碱中毒与低钾血症（A对）常常伴发。代谢性碱中毒对钙离子、钠离子、磷离子和镁离子浓度无明显影响（BCDE错）。